关于根除幽门螺杆菌四联疗法中的药物使用时间，说法正确的是
A. 克拉霉素分别于早餐和晚餐前30分钟服用
B. 阿莫西林分别于早餐和晚餐前30分钟服用
C. 奥美拉唑分别于早餐和晚餐前30分钟服用
D. 枸橼酸铋钾分别于早餐和晚餐后30分钟服用
E. 四种药物均要餐后服用

正确答案：C。奥美拉唑分别于早餐和晚餐前30分钟服用

解析：本题考查胃溃疡患者用药教育。奥美拉唑为PPI药物，服药时间影响PPI的最佳药效，每天服药的时间应为早餐前0.5～1小时；如果每天服药2次，第二次应于晚餐前0.5～1小时给药（C对）。